判断水质是否受粪便污染的重要指标
A. 细菌总数
B. 大肠菌群
C. 粪大肠菌群
D. 厌氧芽胞菌
E. 痢疾杆菌

正确答案：C。粪大肠菌群

解析：本题考查判断水质是否受粪便污染的重要指标。耐热大肠菌群即粪大肠菌群（C对ABDE错），是一群在44.5℃培养24小时，能使乳糖发酵产酸产气的细菌。它来源于人和温血动物粪便，是判断饮用水是否受粪便污染的重要微生物指标。